兴奋性突触后电位是指突触后膜出现
A. 极化
B. 去极化
C. 超极化
D. 反极化
E. 复极化

正确答案：B。去极化